药用部位为带叶茎枝的是
A. 紫花地丁
B. 麻黄
C. 穿心莲
D. 通草
E. 槲寄生

正确答案：E。槲寄生

解析：本题考查的是茎木类中药的药用部位。药用部位为带叶茎枝的是槲寄生（E对）。药用部位为木本植物的茎藤或仅用其木材部分，少数为草本植物茎藤，这类中药称“茎木类中药”。实际上应属于两类，即茎类中药和木类中药。（1）茎类中药：药用为植物的茎藤、茎枝、茎刺或茎的髓部，这类中药称“茎类中药”。药用为木本植物藤茎的，如川木通、大血藤、鸡血藤等；药用为带叶茎枝的，如桑寄生、槲寄生；药用为嫩枝的，如桂枝、桑枝等；药用为棘刺的，如皂角刺；药用为茎翅状附着物的，如鬼箭羽；药用为茎髓的，如通草（D错）、灯心草；药用为新鲜或干燥茎的，如石斛等。（2）木类中药：药用为木本植物茎形成层以内的部分，这类中药称为“木类中药”。其药用部位实际为木材。木材又分为边材和心材两部分。边材形成较晚，含水分较多，颜色较浅，亦称液材；心材形成较早，位于木质部内方，蓄积了较多的物质，如树脂、树胶、单宁、挥发油等，颜色较深，质地较致密。木类中药多采用心材部分，如沉香、降香、檀香、苏木等。紫花地丁（A错）、麻黄（B错）与穿心莲（C错）为全草类中药。药用部位为草本植物新鲜或干燥的全体或地上部分，这类中药称为全草类中药。有的药用部位为草本植物全体，如紫花地丁、蒲公英、金钱草、半枝莲、车前草等；有的药用部位为草本植物地上部分，如益母草、广金钱草、广藿香、薄荷、穿心莲、香薷、茵陈、青蒿、大蓟等；有的药用部位为草本植物肉质茎或带鳞叶的肉质茎，如锁阳、肉苁蓉等；有的药用部位为草本植物草质茎，如麻黄；有的药用部位为草本植物茎叶，如淡竹叶。